24岁男性，农民。因畏寒发热起病，伴全身肌肉酸痛，头痛4天，于8月10日入院。入院1天发现皮肤黄染，尿量减少，尿色深黄，查体：结膜充血，巩膜及皮肤中度黄染，皮肤有出血点，浅表淋巴结肿大，肝肋下lcm，压痛（+），脾（-），实验室检查WBC15.4×10⁹/L，N80%，L20%，尿检：尿蛋白（+），颗粒管型，WBC8～15/HP，RBC20～30/HP，BUN24mmol/L，凝集溶解试验阳性。确定诊断的指标是什么
A. 流行病学资料
B. 临床表现
C. 血培养
D. 便培养
E. 凝集溶解试验

正确答案：C。血培养

解析：患者起病出现早期中毒综合征，有“三症状”，即畏寒发热、肌肉酸痛、全身乏力，眼结膜充血、腓肠肌压痛、淋巴结肿大、肝大，凝集溶解试验阳性，应为钩端螺旋体病。该病诊断要依靠流行病学（A错），临床表现（B错）和实验室检查。其中特异性血清学检查或病原学检查（C对）阳性，可明确诊断。便培养（D错）不用于诊断钩端螺旋体病，凝集溶解试验（E错）凝集效价≥1：400，或早、晚期两份血清比较，效价增加4倍有诊断意义，但不能确诊。